某县药品经营企业对本县药品监督管理部门做出的行政处罚决定不服，欲申请行政复议。受理该行政复议申请的机关可以是
A. 所在地市级药品监督管理部门
B. 所在地省级人民政府
C. 所在地市级人民政府
D. 本县人民法院

正确答案：A。所在地市级药品监督管理部门

解析：本题考查的是行政复议机关。某县药品经营企业对本县药品监督管理部门做出的行政处罚决定不服，欲申请行政复议。受理该行政复议申请的机关可以是所在地市级药品监督管理部门（A对）。《行政复议法》规定的行政复议机关是和行政复议管辖相联系的。对行政复议案件拥有管辖权的机关，就是行政复议机关。行政复议管辖：（1）一般级别管辖：一般情况下，行政复议案件由被申请人的上一级行政机关管辖，包括：第一，选择管辖。对县级以上地方各级人民政府工作部门的具体行政行为不服的，由申请人选择，可以向该部门的本级人民政府（D错）申请行政复议，也可以向上一级行政主管部门申请行政复议。第二，政府管辖。对地方各级人民政府作出的具体行政行为不服的，由上一级人民政府管辖（C错）。其中，省政府依法设立的派出机关即行政公署可以管辖对所属县级地方政府的具体行政行为申请复议的案件。第三，垂直管辖。对实行垂直领导的国家行政机关，如海关、金融、国税、外汇管理等行政机关和国家安全机关的具体行政行为不服的，向上一级主管部门申请行政复议。申请人对经国务院批准实行省以下垂直领导的部门作出的具体行政行为不服的，可以选择向该部门的本级人民政府或者上一级主管部门申请行政复议，但是省、自治区、直辖市另有规定的，依照省、自治区、直辖市的规定办理。（2）特殊级别管辖：主要包括：第一，自身管辖。对国务院部门或者省、自治区、直辖市人民政府的具体行政行为不服的，向作出该具体行政行为的国务院部门或者省、自治区、直辖市人民政府（B错）申请复议。为了方便行政相对人申请行政复议，《行政复议法实施条例》第23条规定，申请人对两个以上国务院部门共同作出的具体行政行为不服的，可以向其中任何一个国务院部门提出行政复议申请，由作出具体行政行为的国务院部门共同作出行政复议决定。第二，共同管辖。对两个或者两个以上行政机关以共同名义作出的具体行政行为不服的，向其共同上一级行政机关申请行政复议。第三，派出管辖。对县级以上地方人民政府依法设立的派出机关（包括地区行政公署、街道办事处、区公所）的具体行政行为不服的，向设立该派出机关的人民政府申请复议；对政府工作部门依法设立的派出机构依照法律、法规或规章的规定，以自己名义作出的具体行政行为不服的，向设立该派出机构的部门或者该部门的本级地方人民政府申请行政复议。第四，授权管辖。对法律、法规授权组织作出的具体行政行为不服的，分别向直接管理该组织的地方人民政府、地方人民政府工作部门或者国务院部门申请行政复议。第五，撤销管辖。对被撤销的行政机关在撤销前所作出的具体行政行为不服的，向继续行使其职权的行政机关的上一级行政机关申请行政复议。第六，转送管辖。根据《行政复议法》第15条第2款的规定，对特殊情况下的复议管辖，申请人也可以向具体行政行为发生地的县级地方人民政府提出行政复议申请，由该县级地方人民政府在7日内，将该申请转送到有关的行政复议机关。这充分体现了行政复议便民原则。